确定白喉棒状杆菌是否产生毒素的依据是
A. 奈瑟染色有异染颗粒
B. 吕氏斜面快速长出灰白菌落
C. 亚碲酸钾平板呈黑色菌落
D. 锡克试验
E. Elek平板试验

正确答案：E。Elek平板试验